烷化剂环磷酰胺与DNA碱基之间，形成的主要键合类型是
A. 共价键
B. 氢键
C. 离子－偶极和偶极－偶极相互作用
D. 范德华引力
E. 疏水性相互作用

正确答案：A。共价键

解析：本题考查药物与生物大分子相互作用的方式。共价键（A对）是原子间通过共用电子对形成的化学键。共价键键合类型多发生在化学治疗药物的作用机制上，例如烷化剂类抗肿瘤药物，此类药物与DNA中鸟嘌呤碱基形成共价键，产生细胞毒活性。氢键（B错）是非共价作用形式，是药物分子中含有孤对电子的O、N、S等原子和与非碳的杂原子以共价键相连的氢原子之间形成的弱化学键。偶极-偶极相互作用（C错）在羰基类化合物中比较常见，如乙酰胆碱和受体的作用。范德华引力（D错）一般指分子间作用力，即存在于中性分子或原子之间的一种弱碱性的电性吸引力。疏水性相互作用（E错）是非极性分子之间的一种弱的、非共价的相互作用，是通过疏水物的疏水基与水相互排斥作用而发生的，疏水基一般是非极性基。这种作用使疏水基相互靠拢，同时使水相互集中并更大程度地结构化。